“动极者镇之以静，阴亢者胜之以阳”说明了阴阳之间的什么关系
A. 阴阳对立
B. 阴阳互根
C. 阴阳制约
D. 阴阳转化
E. 阴阳平衡

正确答案：C。阴阳制约

解析：阴阳对立，指阴阳“一分为二”，即对待相反的关系，是事物或现象固有的属性。阴阳学说认为，对立相反是阴阳的基本属性，宇宙间很多事物和现象都存在对立相反的两个方面。如天与地、日与月、水与火、男与女、寒与热、动与静、上与下、左与右等（A错）。阴阳互根，指阴阳的互为根本、相互依存的关系，即“阳根于阴，阴根于阳”。阳的根本在阴，阴的根本在阳，双方互为存在的前提（B错）。阴阳制约的意义，在于防止阴阳的任何一方不至于亢盛为害，以维持阴阳之间的协调平衡（C对）。阴阳转化，指事物的阴阳属性，在一定条件下可以向其相反的方向转化，即属阳的事物可以转化为属阴的事物，属阴的事物可以转化为属阳的事物（D错）。阴阳平衡是生命活力的根本。阴阳平衡就是阴阳双方的消长转化保持协调，既不过分也不偏衰，呈现着一种协调的状态。阴阳平衡则人健康、有神；阴阳失衡人就会患病、早衰，甚至死亡（E错）。